对流动人口中的传染性非典型肺炎患者、疑似患者处理的原则是
A. 就地控制、就地治疗、就地康复
B. 就地隔离、就地治疗、就地康复
C. 就地控制、就地观察、就地治疗
D. 就地隔离、就地观察、就地治疗
E. 就地观察、就地治疗、就地康复

正确答案：D。就地隔离、就地观察、就地治疗